药品生产企业不得委托其他药品生产企业生产的是
A. 血液制品
B. 中药饮片
C. 化学原料药
D. 医院制剂
E. 中成药

正确答案：A。血液制品

解析：本题考查的是药品委托生产管理。药品生产企业不得委托其他药品生产企业生产的是血液制品（A错，为本题正确答案）。依法自行生产或委托生产药品：上市许可持有人自行生产药品的，应当依照《药品管理法》规定取得药品生产许可证；委托生产的，应当委托符合条件的药品生产企业。药品上市许可持有人和受托生产企业应当签订委托协议和质量协议，并严格履行协议约定的义务。血液制品、麻醉药品、精神药品、医疗用毒性药品、药品类易制毒化学品不得委托生产；但是，国务院药品监督管理部门另有规定的除外。